黄体酮的红外吸收光谱中，20位酮羟基的伸缩震动（νC=O）的吸收峰的波数
A. 3500～3300cm⁻¹
B. 3500cm⁻¹
C. 1695cm⁻¹
D. 1615cm⁻¹
E. 870cm⁻¹

正确答案：C。1695cm⁻¹

解析：本题考查红外吸收光谱。酮羟基的νC=O吸收峰归属基团是C=O（醛、酮），故峰位在1900～1650cm⁻¹（C对）。3750～3000cm⁻¹（AB错）归属O-H或N-H。1615cm⁻¹（D错）归属C=C。870cm⁻¹（E错）是不同取代形式双键、苯环的特殊吸收峰。